处方书写补骨脂，应付
A. 盐炙品
B. 醋炙品
C. 麸炒品
D. 清炒品
E. 酒炒品

正确答案：A。盐炙品

解析：本题考查的是饮片的处方应付。处方书写补骨脂，应付盐炙品（A对）。处方直接写药名（或炒或炙），需调配盐炙品，如补骨脂、益智仁等。处方直接写药名（或炒或炙），需调配醋炙品（B错），如延胡索等。处方直接写药名（或炒），需调配麸炒品（C错），如僵蚕、白术、枳壳等。处方直接写药名（或炒），需调配清炒品（D错），如紫苏子、莱菔子、谷芽、麦芽、王不留行、酸枣仁、蔓荆子、苍耳子、牛蒡子、白芥子等。